患者，女，30岁。平素体弱多病，易疲倦，月经周期常常推迟7天以上，量少，色淡红，质清稀，伴小腹隐痛，喜温喜按，舌淡，苔白，脉细弱。其治疗时，方剂宜选
A. 理中丸
B. 吴茱萸汤
C. 大补元煎
D. 桃红四物汤
E. 温经汤

正确答案：E。温经汤

解析：阳气不足,阴寒内盛,不能温养脏腑,气血化生不足,冲任不充,血海满溢延迟,故月经推迟而至，量少；阳虚血失温煦,故经色淡红,质稀；阳虚不能温煦子宫,故小腹隐痛,喜暖喜按。舌淡,苔白,脉沉迟或细弱,为虚寒之征。治宜温阳散寒，养血调经，方药可选用温经汤（E对）。